2～5ml剂量所对应的给药方法是
A. 静脉注射
B. 椎管注射
C. 肌内注射
D. 皮下注射
E. 皮内注射

正确答案：C。肌内注射

解析：本题考查注射给药的给药部位和吸收途径。肌内注射（C对）剂量为2～5ml；静脉注射（A错）一般剂量超过10ml；椎管注射（B错）剂量不得超过10ml；皮下注射（D错）剂量为1～2ml；皮内注射（E错）用量在0.2ml以内。